慢性阻塞性肺疾病所致Ⅰ型呼吸衰竭最主要的机制
A. 肺内分流
B. 肺弥散功能降低
C. 肺泡通气量下降
D. 肺通气/血流比例失衡
E. 闭塞性通气功能障碍

正确答案：D。肺通气/血流比例失衡

解析：I型呼吸衰竭：即低氧性呼吸衰竭，血气分析特点是PaO₂<60mmHg，PaCO₂降低或正常。主要见于肺换气功能障碍（P135）。COPD患者肺气肿加重导致大量肺泡周围的毛细血管受肺泡膨胀的挤压而退化，致使肺毛细血管大量减少，肺泡间的血流量减少，此时肺泡虽有通气，但肺泡壁无血液灌流，导致生理无效腔气量增大，从而产生通气与血流比例失调，是COPD所致Ⅰ型呼吸衰竭最主要的机制。肺内分流（A错）、肺弥散功能降低（B错）不是最主要的机制。肺泡通气量下降（C错）、闭塞性通气功能障碍（E错）属于Ⅱ型呼吸衰竭的原因。